位于下颌角以上及腮腺区的鳃瘘常为
A. 第一腮裂来源
B. 第二腮裂来源
C. 第三腮裂来源
D. 第四腮裂来源
E. 第五腮裂来源

正确答案：A。第一腮裂来源

解析：第一腮裂来源的鳃瘘的位置为下颌角以上及腮腺区者。掌握“鳃弓与神经嵴”知识点。